腹膜炎的主要标志是
A. 明显的腹胀
B. 剧烈的腹绞痛
C. 腹部移动性浊音
D. 肠鸣音减弱或消失
E. 腹膜刺激征

正确答案：E。腹膜刺激征

解析：腹膜炎的主要标志是腹膜刺激征（E对），即腹部压痛、反跳痛和腹肌紧张。腹胀（A错）是腹膜炎的一般体征，腹胀加重常常提示病情恶化；腹腔内积液较多时，可出现移动性浊音阳性（C错）；腹膜炎症可导致肠蠕动减弱或肠麻痹，听诊时肠鸣音减弱或消失（D错），上述体征均不是腹膜炎的标志性体征。腹部绞痛（B错）常见于胆结石或部分泌尿系结石患者。